阑尾手术切口的标志点是
A. 麦氏点
B. 华氏点
C. 墨氏点
D. 雷氏点
E. 左下腹点

正确答案：A。麦氏点

解析：阑尾体表投影约在脐与右髂前上棘连线中外1/3交界处，称为麦氏点，是选择阑尾手术切口的标记点（A对）。